男，60岁。1小时前突发呕血500ml，既往有慢性乙肝病史。查体：P105次／分，BP95/70mmHg，轻度烦躁。目前最主要的处理是
A. 输注胶体扩容
B. 输注晶体扩容
C. 输红细胞悬液
D. 应用止血药
E. 输全血

正确答案：B。输注晶体扩容

解析：1小时前突发呕血500ml（出血量大于400ml， 可出现头晕、心悸、乏力等症状），既往有慢性乙肝病史。查体：P105次／分（心率增快），BP95/70mmHg（血压下降血容量不足），轻度烦躁。应积极补充血容量，输注晶体扩容（B对）。输红细胞悬液（C错）、应用止血药（D错）、输全血（E错）均不是休克的首要治疗方法。